调节三羧酸循环的最重要的酶是
A. 葡萄糖-6-磷酸酶
B. 磷酸烯醇式丙酮酸羧激酶
C. 异柠檬酸脱氢酶
D. 苹果酸脱氢酶
E. 己糖激酶

正确答案：C。异柠檬酸脱氢酶